关于坐骨神经的叙述，下列哪项不正确
A. 起自骶丛
B. 经梨状肌下孔出骨盆
C. 多数在腘窝上方分成胫神经和腓总神经
D. 在臀中肌、臀小肌间下行
E. 分支支配股二头肌

正确答案：D。在臀中肌、臀小肌间下行

解析：坐骨神经起自骶丛（A对），经梨状肌下孔出骨盆（B对）至臀大肌深面，在坐骨结节与大转子连线的中点深面下行到达股后区，继而行于股二头肌长头的深面，多数在腘窝上方分成胫神经和腓总神经（C对）两大终支。坐骨神经在股后区发出肌支支配股二头肌（E对）、半腱肌和半膜肌，同时也有分支至髋关节。在臀中肌、臀小肌间下行（D错，为本题正确答案）的神经为臀上神经。